婴儿少尿的标准是每日尿量少于
A. 50ml
B. 100ml
C. 150ml
D. 200ml
E. 250ml

正确答案：D。200ml

解析：婴儿少尿的标准是每日尿量少于200ml（D对）。